静脉注射起效最快的药物是
A. 苯巴比妥钠
B. 戊巴比妥钠
C. 异戊巴比妥钠
D. 司可巴比妥钠
E. 硫喷妥钠

正确答案：E。硫喷妥钠

解析：巴比妥类药是巴比妥酸的衍生物，为弱的有机酸，药物的吸收、分布、消除方式与其脂溶性有密切关系，其中硫喷妥钠（E对）的脂溶性最高，容易透过血脑屏障，静脉注射30秒内立即起效，苯巴比妥（A错）起效时间为30-60分钟，戊巴比妥钠（B错）起效时间为15-50分钟，异戊巴比妥钠（C错）起效时间为15-30分钟，司可巴比妥钠（D错）起效时间为15-20分钟。